以下哪种情况不属于医院感染
A. 医院护士在给患者护理过程中获得的感染
B. 院内患者由于医疗器械消毒不严而引起的感染
C. 住院患者因与其他患者直接接触而被传染病毒性感冒
D. 刚入院两天的外科患者被确诊患有甲型肝炎
E. 长期使用广谱抗生素的住院患者发生葡萄球菌肠炎

正确答案：D。刚入院两天的外科患者被确诊患有甲型肝炎